关于万古霉素合理使用的注意事项有
A. 静脉滴速过快可引起红人综合征，滴注时间至少应在60min以上
B. 肾功能不全患者无需调整剂量
C. 与替考拉宁有交叉过敏反应
D. 万古霉素只能用葡萄糖注射液稀释
E. 老年患者或肾功能不全患者使用时易发生听力减退甚至耳聋

正确答案：A、C、E。静脉滴速过快可引起红人综合征，滴注时间至少应在60min以上；与替考拉宁有交叉过敏反应；老年患者或肾功能不全患者使用时易发生听力减退甚至耳聋

解析：本题考查万古霉素的使用。万古霉素使用注意事项：（1）万古霉素不宜肌内注射，静脉滴注时应尽量避免药液外漏，且应经常更换注射部位，滴注速度应缓慢，滴注时间至少在60min以上；（2）肾功能不全者调整维持剂量（B错），有条件时应根据血药浓度监测结果调整剂量。（3）万古霉素与替考拉宁有交叉过敏反应（C对），对万古霉素、去甲万古霉素和替考拉宁过敏者禁用。（4）万古霉素滴注过快易引起“红人综合征”，所以要求0.5g万古霉素以至少100ml的0.9%氯化钠注射液或5%葡萄糖注射液稀释（D错），静滴时间须在60分钟以上（A对）。（5）万古霉素具有耳毒性和肾毒性，老年患者或肾功能不全患者使用时易发生听力减退甚至耳聋（E对）。